流行病资料提示下列哪项指标可能与心血管疾病死亡率增高有关
A. 水中硬度高
B. 水中硬度低
C. 水中氯含量高
D. 水中氟含量高
E. 水中硝酸盐高

正确答案：B。水中硬度低

解析：本题考查硬度的相关内容。硬度指溶于水中钙、镁盐类的总含量。天然水的硬度因地质条件不同差异很大，地下水的硬度一般均高于地表水，水中硬度低（B对ACDE错）可能导致心血管疾病死亡率增高。